属于望苔质的内容是
A. 舌红绛或淡白
B. 萎软还是强硬
C. 苍老还是娇嫩
D. 腻腐还是润燥
E. 胖大还是痩薄

正确答案：D。腻腐还是润燥

解析：望苔质即望舌苔的质地、形态。临床上常见的苔质变化有厚薄苔、润燥苔、腻腐苔、剥落苔、偏全苔、真假苔等方面（D对）。舌红绛或淡白（A错）属于望舌色的内容，包括淡红、淡白、红、绛、青紫五种。萎软还是强硬（B错）属于望舌态的内容，包括萎软、强硬、歪斜、颤动、吐弄等。苍老还是娇嫩（C错）属于望舌形的内容，包括老嫩、胖瘦、点刺、裂纹、齿痕等方面的特征。胖大还是痩薄（E错）属于望舌形的内容，包括老嫩、胖瘦、点刺、裂纹、齿痕等方面的特征。